关于莫西沙星作用特点的说法，错误的是
A. 莫西沙星抗菌谱广，对常见革兰阴性及革兰阳性菌均具有良好抗菌活性
B. 莫西沙星可经验性用于社区获得性肺炎的治疗
C. 莫西沙星组织分布广泛，但不能透过血脑屏障
D. 莫西沙星属于浓度依赖型抗菌药物
E. 莫西沙星可导致血糖紊乱

正确答案：C。莫西沙星组织分布广泛，但不能透过血脑屏障

解析：本题考查莫西沙星作用特点。莫西沙星组织分布广泛，能透过血脑屏障（C错，为本题正确答案），在治疗某些严重的感染性脑膜炎中有作用。莫沙西星抗菌谱广，对常见革兰阳、阴性菌均具有良好抗菌活性（A对）。莫西沙星属于浓度依赖性抗菌药物（D对），可用于社区获得性肺炎（B对）及皮肤和软组织感染，同时也可致血糖紊乱（E对）。